小儿贫血之心脾两虚证的代表方是
A. 六君子汤
B. 参苓白术散
C. 归脾汤
D. 左归丸
E. 补中益气汤

正确答案：C。归脾汤

解析：小儿贫血心脾两虚证，因脾胃虚弱，气血生化不足，继则血不养心，而致心脾两虚，治宜补脾养心，益气生血，选用归脾汤（C对）。六君子汤功效益气健脾，燥湿化痰，主治脾胃气虚兼痰湿证（A错）。参苓白术散功效益气健脾，渗湿止泻，主治脾虚湿盛证（B错）。左归丸功效滋阴补肾，填精益髓，主治真阴不足证（D错）。补中益气汤功效补中益气，升阳举陷，主治脾胃气虚证，气虚下陷证，气虚发热证（E错）。